中年男性，有顽固性膀胱刺激症状伴终末血尿，应先考虑
A. 急性膀胱炎
B. 急性肾盂肾炎
C. 泌尿系结核
D. 膀胱结石
E. 膀胱肿瘤

正确答案：C。泌尿系结核

解析：顽固性膀胱刺激征伴终末血尿为泌尿系结核的典型表现，出现该症状时应首先考虑泌尿系结核（C对）的可能。急性膀胱炎（A错）典型表现为突发的膀胱刺激症状伴终末血尿。急性肾盂肾炎（B错）多见于新婚期及老年女性，主要表现为发热、腰痛和膀胱刺激征，尿细菌培养可确诊。膀胱结石（D错）典型症状为排尿突然中断，疼痛放射至远端尿道及阴茎头部，伴排尿困难和膀胱刺激症状。膀胱肿瘤（E错）典型表现为间歇性、全程无痛性肉眼血尿，膀胱刺激征多为晚期表现。